在随机抽样时，样本人群由于主观或客观原因未能接受检查出现的偏倚称为
A. 无应答偏倚
B. 标准误差
C. 选择性偏倚
D. 决定性偏倚
E. 测量误差

正确答案：A。无应答偏倚

解析：无应答偏倚：在随机抽样时，属于样本人群中的受检者，由于主观或客观原因未能接受检查，如未接受检查的人数达到抽样人数的30%，应答率仅有70%，结果就难以用来估计总体的现患率。掌握“口腔健康状况调查的样本含量及误差”知识点。